“伤寒表不解，心下有水气”，针对这种病机，选方应用
A. 大青龙汤
B. 麻黄汤
C. 桂枝汤
D. 葛根汤
E. 小青龙汤

正确答案：E。小青龙汤

解析：“伤寒表不解”，除条中所载发热外，应见恶寒、无汗、脉浮紧等；“心下有水气”，是水饮停蓄于心下胃脘部。此处内近肺胃，水饮扰胃，胃气上逆则呕；水寒射肺，肺气失宣则咳。自“或渴”以下，皆为或然症。由于水饮之邪变动不居，可随三焦气机升降出入，或壅于上，或积于中，或滞于下，故其症状也多有变化。水停为患，一般不渴，但饮停不化，津液不滋。也可口渴，但多渴喜热饮，或饮量不多；水走肠间，清浊不分则下利；水寒滞气，气机不利，故小便不利。甚则少腹胀满；水寒射肺，肺气上逆则喘。诸或然症，并非必然出现，但病机关键为水饮内停。本证外有表寒，内有水饮，故以小青龙汤发汗蠲饮，表里同治（E对）。